《执业医师法》规定，在医疗预防保健机构中试用期满一年，具有以下学历者，可以参加执业医师资格考试
A. 高等学校医学专业本科以上学历
B. 高等学校医学专业专科学历
C. 取得助理执业医师执业证书后，具有高等学校医学专科学历
D. 中等专业学校医学专业学历
E. 取得助理执业医师执业证书后，具有中等专业学校医学专业学历

正确答案：A。高等学校医学专业本科以上学历

解析：根据《执业医师法》和相关规定，具有下列条件之一的，可以参加执业医师资格考试：①具有高等学校医学专业本科以上学历（A对B错），在执业医师指导下，在医疗、预防、保健机构中试用期满1年；②取得执业助理医师执业证书后，具有高等学校医学专科学历（CE错），在医疗、预防、保健机构中试用期满2年；③具有中等专业学校医学专业学历（D错），并在医疗、预防、保健机构中试用期满5年；④以师承方式学习传统医学满3年或者经多年实践医术确有专长的，经县级以上政府卫生行政部门确定的传统医学专业组织或在医疗、预防、保健机构考核合格并推荐。